阴偏衰的主要病机是
A. 阴液亏损，阳气化生亦不足
B. 阳气亢盛，阴气相对不足
C. 阳气亢盛，消耗精血津液
D. 人体阴气不足，机体虚性亢奋
E. 阳热盛极，格阴于外

正确答案：D。人体阴气不足，机体虚性亢奋

解析：阴偏衰的病机特点为阴液不足，阴不制阳，阳气相对偏盛，临床表现为虚热证（D对）；阴损及阳指由于阴气亏损，累及阳气生化不足，或阳气无所依附而耗散从而在阴虚的基础上又出现阳虚，形成以阴虚为主的阴阳两虚的病机变化（A错）；阳偏盛即阳气亢盛，阳长阴消，阳盛则阴病，可耗伤阴液导致阴气相对不足（BC错）；阳盛格阴，指阳气偏盛至极，壅遏于内，排斥阴气于外（E错）。